16岁女孩，因害怕身体变胖，每天只吃少量的水果和蔬菜，目前出现头晕、气短、食欲减退、注意力不集中等症状。到医院检查：13岁月经初潮，身高155cm，体重45kg，血红蛋白为90g/L，红细胞为3.0✕10¹²/L，血细胞比容为0.29，白细胞和血小板计数均在正常范围。该女孩最可能的诊断是
A. 发育不良
B. 缺铁性贫血
C. 巨细胞性贫血
D. 再生障碍性贫血
E. 营养过剩

正确答案：B。缺铁性贫血

解析：本题考查缺铁性贫血的相关内容。铁是血红蛋白的重要成分。该女孩因害怕身体变胖，每天只吃少量的水果和蔬菜，膳食中缺铁，且月经丢失血液，铁也随之丢失，就会造成缺铁性贫血（B对ACDE错），特别是青少年女性。